肝病传脾的理论依据是
A. 五行相侮
B. 五行相乘
C. 五行相克
D. 五行相生
E. 五行制化

正确答案：B。五行相乘

解析：本题考查的是五行的生克乘侮。肝病传脾的理论依据是五行相乘（B对）。肝与木对应，脾与土对应，木克土，肝病传脾属于五行相乘。五行的生克乘侮：（一）五行的相生相克：1.五行相生（D错）：五行相生，是指木、火、土、金、水之间存在着有序的资生、助长和促进的作用。五行相生的次序是：木生火，火生土，土生金，金生水，水生木。2.五行相克（C错）：五行相克，是指木、土、水、火、金之间存在着有序的克制、制约的作用。五行相克的次序是：木克土，土克水，水克火，火克金，金克木。（二）五行的相乘相侮：1.五行相乘：五行相乘，是指五行的某一行对所胜一行克制太过，从而引起一系列的异常相克反应，也称为“过克”。乘，即是以强凌弱的意思。引起相乘的原因，不外乎“太过”“不及”两个方面：其一，太过所致相乘：所不胜一行过于强盛，因而造成对所胜一行的克制太过，促使所胜一行的虚弱，引起五行之间的生克制化异常。例如，木过于强盛，则克土太过，造成土的不足，即称为“木乘土”。其二，不及所致相乘：所胜一行虚弱不及，因而“克我”的所不胜一行就相对增强，造成对所胜一行的克制太过，而其本身就更加衰弱。例如，木本不过于强盛，其克制土的力量也仍在正常范围，但由于土本身的不足，因而形成了木克土的力量相对增强，使土更加不足，即称为“土虚木乘”。2.五行相侮（A错）：五行相侮，是指由于五行的某一行对所不胜一行进行反向克制，又称“反侮”或“反克”。引起相侮的原因，也有“太过”“不及”两个方面：其一，太过所致相侮：所胜一行过于强盛，使原来克制它的所不胜不仅不能克制它，反而受其反向克制。例如，木气过于亢盛，其所不胜之金不仅不能克木，反而受到木的欺侮，出现“木反侮金”的反向克制现象，称为“木亢侮金”。其二，不及所致相侮：所不胜一行过于虚弱，不仅不能制约其所胜的一行，反而受其反向克制。例如，木过度虚弱，其所胜一行的土则相对偏盛，反向克制所不胜一行的木，称为“木虚土侮”。相乘和相侮，都是异常的相克现象，两者之间既有区别又有联系。相乘与相侮的主要区别是：前者是按五行的相克次序发生过强的克制，从而形成五行间相克关系的异常；后者则是与五行相克次序发生相反方向的克制现象，从而形成五行间相克关系的异常。两者之间的联系是在其发生相乘时，也可同时发生相侮；发生相侮时，也可以同时发生相乘。例如，木过强时，既可以乘土，又可以侮金；金虚时，既可以受到木的反侮，又可以受到火乘。五行制化（E错），2022年考试指南未明确说明。